患者男性，60岁。平素短气息促，动则为甚，吸气不利，腰酸腿软，脑转耳鸣，劳累后哮喘易发，面色苍白，舌淡苔白，质胖嫩，脉象沉细。治疗应首选
A. 射干麻黄汤
B. 定喘汤
C. 玉屏风散
D. 六君子汤
E. 金匮肾气丸

正确答案：E。金匮肾气丸

解析：肺主呼气，肾主纳气，久病肺虚及肾，肾失摄纳故见短气息促，动则为甚，吸气不利；腰为肾之府，肾虚则腰酸腿软；肾精亏虚，脑髓失养故见脑转耳鸣；故本病首先考虑肾气虚；从面色苍白，舌淡苔白，质胖嫩，脉象沉细可判断为阳虚；综合分析判断为脾肾阳虚型；首选金匮肾气丸治疗（E对）。射干麻黄汤（A错）具有温肺化饮功效，用于寒饮阻肺所致的哮喘。定喘汤（B错）具有清热化痰平喘功效，用于热痰阻肺所致的哮喘。玉屏风散（C错）具有补肺益气止汗功效，用于肺气虚所致的自汗，易感冒。六君子汤（D错）具有健脾止呕功效，用于脾胃气虚所致的呕吐等症。